属于抗雄激素类的抗肿瘤药是
A. 炔雌醇
B. 他莫昔芬
C. 阿那曲唑
D. 丙酸睾酮
E. 氟他胺

正确答案：E。氟他胺

解析：本题考查抗肿瘤药。氟他胺（E对）为雄激素拮抗剂，用于治疗晚期前列腺癌。炔雌醇（A错）是雌激素类抗肿瘤药。他莫昔芬（B错）是雌激素受体拮抗剂。阿那曲唑（C错）是芳香氨酶抑制剂。丙酸睾酮（D错）是雄激素类抗肿瘤药。